男，70岁。活动后气短进行性加重3年，突发心悸伴喘息2小时。既往陈旧性前壁心肌梗死4年。查体：P96次/分BP160/70mmHg。端坐位，双肺可闻及湿啰音，心率125次/分，心律绝对不齐，S1强弱不等。控制该患者心律失常的首选药物是
A. 地尔硫卓
B. 利多卡因
C. 普罗帕酮
D. 维拉帕米
E. 胺碘酮

正确答案：E。胺碘酮

解析：患者老年男性，活动后气短进行性加重3年，突发心悸伴喘息2小时（充血性心衰临床表现）。既往陈旧性前壁心肌梗死4年（房颤病因）。查体：P96次/分，心率125次/分（脉率＜心率，为脉搏短绌），心律绝对不齐，S1强弱不等（房颤的典型表现），结合患者病史、临床表现，易诊断为房颤。房颤的治疗包括1.抗凝；2.转复及维持窦性心律：3.控制心室率。胺碘酮（E对）既可以帮助转复并维持窦性心律，又可控制心室率，且致心律失常发生率最低，特别适用于器质性心脏病患者，故首选。普罗帕酮（C错）易导致室性心律失常，严重器质性心脏病病人不宜应用。利多卡因（B错）多用于控制室性快速型心律失常。